执业药师的基本技能是指在提供药学服务的各个环节所必须具备的专业技术方法与工作能力。不属于执业药师基本技能的是
A. 处方审核
B. 处方调剂
C. 处方点评
D. 用药咨询
E. 药品配送

正确答案：E。药品配送

解析：本题考查的是中药药学服务对执业药师的要求。执业药师的基本技能是指在提供药学服务的各个环节所必须具备的专业技术方法与工作能力。不属于执业药师基本技能的是药品配送（E错，为本题正确答案）。执业药师的基本技能是指在提供药学服务的各个环节所必须具备的专业技术方法与工作能力。基本技能主要包括：中药处方审核（A对）、调剂与复核（B对）、处方点评（C对）、医嘱审核、提供用药咨询（D对）和健康宣教的药学服务技能；阅读医疗文书、问诊及常规查体、辨证中医常见病证并提供用药方案、利用临床思维分析药学问题的基本临床技能；对特殊人群进行治疗药物监测，设计中医药治疗个体化给药方案的技能；中药信息检索、书写公众宣传材料和为患者提供用药安全教育的技能；收集、整理、分析并反馈中药安全信息开展中药药物评价的技能等。